同名的阳经与阳经交接在
A. 胸部
B. 四肢部手足末端
C. 头面部
D. 腰背部
E. 腹部

正确答案：C。头面部

解析：十二经脉相互交接的规律是：1.相表里的阴经与阳经在四肢末端交接，如手太阴肺经与手阳明大肠经交接于食指端。2.同名的阳经与阳经在头面部交接，如手阳明大肠经与足阳明胃经交接于鼻旁（C对）。3.相互衔接的阴经与阴经在胸中交接，如足太阴脾经与手少阴经交接于心中。